在脑的离体标本，哪个部位能观察到间脑
A. 脑的背侧面
B. 脑的腹侧面
C. 脑的前面
D. 脑的后面
E. 脑的外侧面

正确答案：B。脑的腹侧面

解析：大脑半球高度发展掩盖了间脑的两侧和背面，导致脑的背侧面（A错）、脑的前面（C错），脑的后面（D错）、脑的外侧面（E错）均不能能观察到间脑，仅腹侧的视交叉、灰结节、漏斗、垂体和乳头体露于脑底，因此在脑的离体标本，仅脑的腹侧面（B对）能观察到间脑。